老年患者，前臂外伤25小时余来诊。查体为前臂畸形，反常活动，创口流血，腕手活动自如，应考虑
A. 桡神经损伤
B. 尺神经损伤
C. 开放性骨折
D. 正中神经损伤
E. 前臂肌破损伤

正确答案：C。开放性骨折

解析：患者外伤后出现前臂畸形、反常活动，提示出现骨折（畸形、异常活动、骨擦音或骨擦感为骨折特有体征，只要出现其一，即可诊断为骨折）。加之创口流血，应诊断为开放性骨折（P612）（C对）。桡神经损伤（P701）（A错）在前臂者，桡侧腕长伸肌功能完好，伸腕功能基本正常，而有伸拇、伸指障碍，与题干所述手腕活动自如不符。尺神经（P700）（B错）损伤主要表现为爪形手畸形、手指内收及外展障碍、Froment征、手部尺侧半及尺侧一个半手指感觉障碍，与该患者手腕活动自如的表现不相符。正中神经损伤（D错）（P700）在前臂者，表现为拇指对掌功能障碍和手的桡侧半感觉障碍，特别是示中指远节感觉消失，与该患者腕部活动正常的表现不相符。前臂肌破损伤（E错）不会造成前臂畸形、反常活动等骨折特有体征。